办公场所的卫生学特点为
A. 办公人员相对集中，流动性较小
B. 办公人员滞留时间长，活动范围小
C. 办公场所分布范围广泛，基本条件和卫生状况相差较大
D. 办公场所中存在诸多影响人体健康的不利因素
E. 以上全是

正确答案：E。以上全是

解析：本题考查办公场所的卫生学特点。办公场所是指管理或专业技术人员处理（或办理）某种特定事务的室内工作环境。如公职人员、商务职员和企事业单位专业技术或管理人员履行职责的办公环境。其卫生学特点包括：1.办公人员相对集中，流动性较小；2.办公人员滞留时间长，活动范围小；3.办公场所分布范围广泛，基本条件和卫生状况相差较大；4.办公场所中存在诸多影响人体健康的不利因素（E对ABCD错）。